去甲肾上腺素的特点有
A. 含有儿茶酚结构，易被氧化变色
B. 含有儿茶酚结构，易被儿茶酚氧甲基转移酶代谢失活
C. 含有伯氨基团，可被单胺氧化酶氧化代谢失活
D. 含有一个手性碳原子，用其左旋异构体
E. 在有些金属离子催化下，氧化速度加快

正确答案：A、B、C、D、E。含有儿茶酚结构，易被氧化变色；含有儿茶酚结构，易被儿茶酚氧甲基转移酶代谢失活；含有伯氨基团，可被单胺氧化酶氧化代谢失活；含有一个手性碳原子，用其左旋异构体；在有些金属离子催化下，氧化速度加快